某男，56岁。近日肝阳上亢，症见头痛、眩晕、急躁易怒、心悸、失眠。宜选用的中成药是
A. 正天胶囊
B. 松龄血脉康胶囊
C. 芎菊上清片
D. 麝香保心丸
E. 川芎茶调散

正确答案：B。松龄血脉康胶囊

解析：本题考查松龄血脉康胶囊的主治。宜选用的中成药是松龄血脉康胶囊（B对）。松龄血脉康胶囊【主治】肝阳上亢所致的头痛、眩晕、急躁易怒、心悸、失眠；高血压及原发性高脂血症见上述证候者。正天胶囊（A错）【主治】外感风邪、瘀血阻络、血虚失养、肝阳上亢引起的偏头痛、紧张性头痛、神经性头痛、颈椎病型头痛、经前头痛。芎菊上清丸（C错）（片）【主治】外感风邪引起的恶风身热、偏正头痛、鼻流清涕、牙疼喉痛。麝香保心丸（D错）【主治】气滞血瘀所致的胸痹，症见心前区疼痛、固定不移；心肌缺血所致的心绞痛、心肌梗死见上述证候者。川芎茶调散（E错）（丸、颗粒、口服液、袋泡剂、片）【主治】外感风邪所致的头痛，或有恶寒、发热、鼻塞。